女，43岁。发热、咳嗽、少量脓痰2周。既往健康。査体未见明显异常。血常规大致正常，ESR45mm/h。胸部X线片示右上肺渗出性病变伴不规则空洞，无液平。为明确诊断，宜首选的检查是
A. 痰细菌培养+药敏
B. 经支气管镜肺活检
C. 痰涂片抗酸染色
D. 痰涂片革兰染色
E. PPD皮试

正确答案：C。痰涂片抗酸染色

解析：患者发热、咳嗽、少量脓痰2周，既往体健，查体未见明显异常，血常规ESR45mm/h（男0～15mm/h 女0～20mm/h），胸部X线片示右上肺渗出性病变伴不规则空洞。根据患者病史、临床表现及辅助检查提示肺结核可能性大，为明确诊断，宜首选的检查是痰涂片抗酸染色（C对）。痰细菌培养（P66），费时较长，一般2～8周。药敏（P66）主要是初治失败、复发、以及其他复治患者应进行的（A错）。经支气管镜肺活检（B错）属于创伤性检查，不作首选。痰涂片革兰染色（D错）检查欠敏感。纯蛋白衍生物（PPD）实验广泛应用于检出结核分支杆菌的感染，而非检出结核病（E错）。